以泄肝健脾法治疗肝旺脾虚证的治法称
A. 滋水涵木法
B. 益火补土法
C. 培土生金法
D. 金水相生法
E. 抑木扶土法

正确答案：E。抑木扶土法

解析：抑木扶土法是疏肝健脾或平肝和胃以治疗肝脾不和或肝气犯胃病证。适用于木旺乘土或土虚木乘之证（E对）。滋水涵木（A错）是通过滋肾阴以养肝阴的治法，主要用于肾阴亏损而致肝阴不足，甚至肝阳上亢证。益火补土（B错）是通过温肾阳以助脾阳的治法，又称温肾健脾法、温补脾肾法。故脾肾阳虚证治疗宜采用益火补土法。培土制水法（C错）治疗脾虚水泛、水湿停聚病证。金水相生法（D错）主要用于治疗肺阴亏虚，不能滋养肾阴，或肾阴亏虚，不能滋养肺阴的肺肾阴虚证。